高嵌体固位主要靠
A. 环抱固位
B. 钉洞固位
C. 鸠尾固位
D. 倒凹固位
E. 沟固位

正确答案：B。钉洞固位

解析：钉洞固位形是一种比较好的固位形，牙体磨除较少，与钉之间可获得较大的固位力。过去由于害怕损伤牙髓和数个钉洞间不易取得平行，应用受到了限制，近年来已越来越多地采用。高嵌体的牙体预备：高嵌体适用于（牙合）面广泛缺损，或（牙合）面严重磨损而需作咬合重建者，也用于保护薄弱的牙尖。高嵌体的固位主要靠钉洞固位。掌握“金属嵌体”知识点。